被誉为牙周炎的进展前沿革兰氏阴性菌的构成是
A. 牙龈卟啉单胞菌、核梭杆菌、血链球菌
B. 牙龈卟啉单胞菌、福赛坦氏菌、具核梭杆菌
C. 牙龈卟啉单胞菌、黏放线菌、血链球菌
D. 血链球菌、核梭杆菌、中间普氏菌
E. 血链球菌、黏放线菌、核梭杆菌

正确答案：B。牙龈卟啉单胞菌、福赛坦氏菌、具核梭杆菌

解析：非附着性菌斑：主要为革兰阴性厌氧菌，如牙龈卟啉单胞菌、福赛坦氏菌和具核梭杆菌等，还包括许多能动菌和螺旋体。在牙周炎快速进展时，非附着龈下菌斑明显增多，毒力增强，与牙槽骨的快速破坏有关，与牙周炎的发生发展关系密切，被认为是牙周炎的“进展前沿”。掌握“牙周炎病因学”知识点。